作为透皮吸收制剂控释膜材料的是
A. 尿素
B. 氰基丙烯酸烷酯
C. 两者均可
D. 两者均不可

正确答案：D。两者均不可

解析：本题考查经皮给药制剂的处方材料。经皮给药制剂中的控释膜可分为均质膜和微孔膜。尿素和氰基丙烯酸烷酯均不能作为透皮吸收制剂的控释膜材料（D对）。